男，60岁，进食梗噎，烧灼感2个月，食管钡餐造影检查见：食管下段粘膜紊乱断裂，管壁僵硬，应该考虑
A. 食管炎
B. 食管癌
C. 贲门失弛缓症
D. 食管静脉曲张
E. 食管平滑肌瘤

正确答案：B。食管癌

解析：老年患者，进食梗噎感、烧灼感，食管钡餐造影见食管下段黏膜紊乱断裂、管壁僵硬，结合患者临床表现和食管钡餐造影，应该考虑为食管癌（B对）。食管炎（A错）主要表现为“烧心”、吞咽疼痛，钡剂造影多为阴性。贲门失弛缓症（C错）主要表现为间断性咽下困难，钡剂造影典型表现为食管下端及贲门部呈鸟嘴状。食管静脉曲张（D错）钡剂造影典型表现为串珠状充盈缺损。食管平滑肌瘤（E错）可有进食梗咽感，钡剂造影典型表现为“半月状”压迹。